患者，女，38岁，已婚。近半年来，月经23〜25天一行，量少、色红、质稠，持续12〜14天，咽干，潮热，舌红少苔，脉细数。应首先考虑的是
A. 经期延长
B. 月经先期
C. 月经量少
D. 漏下
E. 绝经前后诸证

正确答案：A。经期延长

解析：题中患者经期基本正常，行经时间在12~14天，明显延长，并伴有血热与虚热的症状，故诊断为经期延长（A对）。月经先期为月经提前7天以上，甚至10余日一行，连续两个周期以上者，月经周期不正常（B错）。月经量少为月经量明显减少，或行经时间不足2天，甚或点滴即净者，行经时间短，月经量过少（C错）。漏下易于经期延长相混淆，漏下也有经血淋漓不断，延续数十日或数月不等，但漏下有经期的紊乱，而经期延长月经周期基本正常（D错）。绝经前后诸证为妇女绝经期前后，围绕月经紊乱或绝经出现明显不适证候，如烘热汗出、烦躁易怒、潮热面红、眩晕耳鸣，心悸失眠、腰背酸楚、面浮肢肿、情志不宁等证者，明显不符（E错）。